开放性气胸是指
A. 肺裂伤
B. 支气管破裂
C. 胸部存在伤口
D. 胸部伤口与胸膜腔相通
E. 胸部伤口深达肌层

正确答案：D。胸部伤口与胸膜腔相通

解析：外界空气经胸壁伤口或软组织缺损处，随呼吸自由进出胸膜腔即胸部伤口与胸膜腔相通（D对），也就是开放性气胸。并非所有的胸部损伤均会导致胸膜腔积气，因此胸部存在伤口（C错）以及胸部伤口深达肌层（E错）并不是判断气胸乃至开放性气胸的标准。肺裂伤（A错）属于肺损伤可伴发血气胸。支气管破裂（B错）可引起张力性气胸。